位于下鼻甲后方约1cm处的是
A. 咽隐窝
B. 梨状隐窝
C. 扁桃体窝
D. 咽鼓管咽口
E. 扁桃体小窝

正确答案：D。咽鼓管咽口

解析：咽鼓管咽口(D对)位于鼻咽部侧壁，下鼻甲后方约1cm处。